10岁，右大腿下端疼痛伴高热达39.5℃1天。怀疑为急性化脓性骨髓炎。最有价值的辅助检查是
A. X线摄片检查
B. CT检查
C. 血培养
D. 局部穿刺
E. 血常规检查

正确答案：D。局部穿刺

解析：10岁儿童（急性化脓性骨髓炎的好发年龄，好发于儿童和青少年），右大腿下端（化脓性骨髓炎的好发部位，多发于胫骨近端和股骨远端）疼痛伴高热达39.5℃（正常值为36℃～37℃）1天（早期），结合该患者的临床表现和体征，该患者的诊断考虑为急性化脓性骨髓炎。早期局部脓肿分层穿刺，若抽出脓性混浊液可确诊（D对）。X线片无早期诊断价值（A错），2～3周后可见骨破坏表现和骨膜反应。CT对小的骨脓肿仍难以显示（B错）。血培养可获致病菌，但并非每次培养均可获阳性结果，特别是已经用过抗生素者血培养阳性率更低（C错）。血常规检查可有白细胞升高的表现，但只能说明该患者有感染，而不能诊断为急性化脓性骨髓炎（E错）。